对于继承恒牙已经萌出，未能按时脱落的乳牙，或者恒牙未萌出，保留在恒牙列中的乳牙，是指
A. 牙齿固连
B. 乳牙早失
C. 乳牙迟萌
D. 乳牙滞留
E. 异位萌出

正确答案：D。乳牙滞留

解析：乳牙滞留：是指继承恒牙已萌出，未能按时脱落的乳牙，或恒牙未萌出，保留在恒牙列中的乳牙。牙齿固连：是牙骨质与牙槽骨的直接结合，根尖片显示牙周膜丧失，患牙的（牙合）面低于邻牙正常的（牙合）平面，也被称之为下沉牙或者低（牙合）牙。乳牙迟萌：是乳牙的萌出时间显著晚于正常萌出期。牙齿异位萌出：是指恒牙在萌出过程中未在牙列的正常位置萌出。牙齿的异位萌出多发生在上颌尖牙和上颌第一恒磨牙，其次是下颌侧切牙和第一恒磨牙。掌握“乳牙滞留和乳牙早萌”知识点。